患者瘿肿质软，或大或小，心悸不宁，心烦不寐，目眩手颤，多食消痩，口干咽燥，恶热多汗，舌红少苔，脉细数。其证型是
A. 心肝阴虚
B. 心脾两虚
C. 心胆气虚
D. 心肾阴虚
E. 心阴亏虚

正确答案：A。心肝阴虚

解析：心肝阴虚临床以心阴虚、肝阴虚症状同见为特点，主要表现为心悸不宁，心烦不寐，目眩手颤，口干咽燥，舌红少苔，脉细数（A对）。心脾两虚（B错）临床以心神失养，脾失健运证候为主，见心悸，失眠多梦，食欲不振，腹胀便溏，倦怠乏力，舌淡脉细弱等。心胆气虚（C错）临床以失眠多梦，易惊为特点。心肾阴虚（D错）临床多见心悸，腰膝酸软，耳鸣目眩，舌红少苔，脉细数等。心阴亏虚（E错）多表现为虚热内扰的证候，见心悸失眠，五心烦热，午后潮热，盗汗等。